负责非处方药目录遴选的部门是
A. 国家药典委员会
B. 国务院药品监督管理部门
C. 国务院卫生行政部门
D. 省级药品监督管理部门
E. 省级卫生行政部门

正确答案：B。国务院药品监督管理部门

解析：本题考查处方药和非处方药分类管理办法。负责非处方药目录遴选的部门是国务院药品监督管理部门（B对）。《处方药与非处方药分类管理办法（试行）》第四条：国家药品监督管理局负责非处方药目录的遴选、审批、发布和调整工作。